下列属于过期妊娠引产指征的是
A. 估计胎儿体重大于4500g
B. 高龄产妇
C. 宫颈条件成熟，胎头已经衔接
D. 胎儿宫内窘迫
E. CST和OCT评估为三类

正确答案：C。宫颈条件成熟，胎头已经衔接

解析：已确诊过期妊娠，若有宫颈条件成熟（C对）、12小时内胎动累计数＜10次、持续低E/C比值、羊水过少（羊水暗区＜3cm）或羊水粪染、并发中度或重度妊娠期高血压疾病等情况时应立即终止妊娠，即施行引产手术，而宫颈成熟度是决定引产成功与否的一个重要因素。估计胎儿体重大于4500g（A错）、高龄产妇（B错）、胎儿宫内窘迫（D错）、CST和OCT评估为三类（E错）为剖宫产指征。